患者，女，30岁，已婚。孕1产0，1年前自然流产1次。月经量多、色红、有血块、淋漓不止，头晕心烦，目赤口干，舌暗红苔薄黄，脉弦细数。检查子宫如孕8周大小，宫底部突起，质硬。B型超声波证实为肌壁间肌瘤，应首选的治疗措施是
A. 子宫肌瘤摘除术
B. 全子宫切除术
C. 雄激素加逐淤止血汤
D. 雌激素加逐瘀止血汤
E. 孕激素加逐瘀止血汤

正确答案：A。子宫肌瘤摘除术

解析：患者B超诊断为肌壁间肌瘤，触诊宫底部突起，质硬。属子宫肌瘤，中医归之为癥瘕，同时患者有经量多色红，头晕心烦，目赤口干，舌暗红苔薄黄，脉弦细数等湿热之征，故治疗时要清热利湿，化瘀消癥。方药选用大黄牡丹汤加木通茯苓(CDE错)，手术治疗即进行子宫肌瘤摘除术（A对）。全子宫切除术多用于早期子宫恶性肿瘤，盆腔炎性肿块，子宫肌瘤等良性疾病需要切除子宫，子宫颈有严重病变，或年龄较大、无生育要求或药物治疗无效的妇女，本题患者不需要子宫全切（B错）。